关于氟的论述不正确的是
A. 食用氟是摄入氟的一个最大来源
B. 食物中氟化物的吸收，取决于无机氟化物的溶解度及钙的含量
C. 食物中钙含量增加，可减少对氟的吸收
D. 我国现行水质标准氟浓度为0.5～1.0ppm
E. 维生素A、D可减轻氟对机体的损害

正确答案：A。食用氟是摄入氟的一个最大来源

解析：本题考查氟牙症的病因及防治原则。关于氟的论述不正确的是食用氟是摄入氟的一个最大来源（A错，为本题的正确答案）。饮用水是摄入氟的一个最大来源，约占人体氟来源的65％，食用氟占25％。食物中氟化物的吸收取决于食物中无机氟化物的溶解度及钙的含量（B对）。当食物钙含量增加时，可减少对氟的吸收（C对）。我国现行水质标准氟浓度为0.5～1.0ppm（D对）。维生素A、D及适当的钙、磷，可减轻氟对机体的损害（E对）。